以反复发作性干咳、胸闷为主要症状的疾病是
A. 支气管哮喘
B. 支气管异物
C. 支气管肺炎
D. 支气管结核
E. 支气管肺癌

正确答案：A。支气管哮喘

解析：支气管哮喘的患者典型临床表现为发作性伴有哮鸣音的呼气性呼吸困难，也有的哮喘患者以反复发作性干咳、胸闷为主要症状的不典型表现（A对），以咳嗽为唯一症状的不典型哮喘称为咳嗽变异性哮喘，以胸闷为唯一症状的不典型哮喘称为胸闷变异性哮喘。发生支气管异物（B错）时，异物经声门入气管时，出现剧烈呛咳，有的同时出现短暂憋气和面色青紫，如异物嵌顿于声门，则可出现声嘶及呼吸困难，严重者发生窒息。支气管肺炎（C错）一般为咳嗽、咳痰、发热等症状，细菌感染时多伴有痰液量增加，多无胸闷。支气管结核（D错）患者表现为咳嗽、咳痰，有的患者有咯血症状，全身症状表现为午后低热，盗汗。支气管肺癌（E错）表现为咳嗽、痰血或咯血、气短喘鸣、发热、体重下降等。